我国计划免疫工作“四苗防六病”针对的疾病不包括
A. 结核病
B. 百日咳
C. 白喉
D. 麻疹
E. 乙型脑炎

正确答案：E。乙型脑炎